佐剂的功能不包括
A. 作用于T细胞抗原受体
B. 激活抗原提呈细胞
C. 延长抗原的体内滞留时间
D. 改变免疫应答的类型
E. 增强免疫应答

正确答案：A。作用于T细胞抗原受体

解析：佐剂是指预先或与抗原同时注入体内，可增强机体对该抗原的免疫应答（E对）或改变免疫应答类型（D对）的非特异性免疫增强性物质。佐剂的功能有：改变抗原物理性状，延长抗原降解，延长抗原在体内潴留时间（C对）；刺激抗原提呈细胞，增强其对抗原的加工和提呈（B对）；刺激淋巴细胞的增殖和分化，从而增强和扩大免疫应答（E对）。其功能中不包括作用于T细胞抗原受体（A错，为本题正确答案）。